正确使用泡腾片的方法是先浸泡在
A. 冷水200～250ml中
B. 温水100～150ml中
C. 热水100～150ml中
D. 凉（温）水100～150ml中
E. 凉（温）水200～250ml

正确答案：D。凉（温）水100～150ml中

解析：本题考查泡腾片的正确使用。泡腾片宜（D对）浸泡在凉（温）水100～150ml中，可以迅速崩解和释放药物。泡腾片服用时应注意：①供口服的泡腾片一般宜用100～150ml凉开水或温水浸泡，可迅速崩解和释放药物，应待完全溶解或气泡消失后再饮用；②不应让幼儿自行服用；③严禁直接服用或口含；④药液中有不溶物、沉淀、絮状物时不宜服用。